（牙合）面发育沟可呈现“H”形、“U”形或“Y”形的是
A. 上颌第一前磨牙
B. 上颌第二前磨牙
C. 下颌第一前磨牙
D. 下颌第二前磨牙
E. 上颌第一磨牙

正确答案：D。下颌第二前磨牙

解析：本题考查牙体解剖外形。（牙合）面发育沟可呈现“H”形、“U”形或“Y”形的是下颌第二前磨牙（D对），下颌第二前磨牙的（牙合）面可有两种类型：①两尖型：（牙合）面为椭圆形，颊、舌尖各一个，两尖均偏近中，发育沟多为H形或U形；②三尖型：（牙合）面为方圆型，有一个颊尖和两个舌尖，近中舌尖大于远申舌尖，发育沟多为Y形。上颌第一前磨牙（A错）中央窝底部有中央沟，两端有近颊沟、近中沟、远颊沟，不构成题目中所述形状。上颌第二前磨牙（B错）的中央沟短，（牙合）面无沟跨过近中边缘嵴至近中面，不构成题目中所述形状。下颌第一前磨牙（C错）的中央沟被横嵴分成近中沟和远中沟，近中沟跨越边缘嵴至舌面为近中舌沟，不构成题目中所述形状。上颌第一磨牙（E错）（牙合）面发育沟主要有颊沟、近中沟、远中舌沟还有一些副沟，不构成题目中所述形状。另有一些牙发育沟呈特殊形状，如下颌第一磨牙（牙合）面发育沟呈“大”字型；下颌第二磨牙（牙合）面发育沟呈“十”字型。